男，30岁。1天前饮大量酒后出现上腹痛，呕吐，吐后疼痛不减轻，加重伴腹胀3h。血淀粉酶650U/L（somogyi），血压80/60mmHg，脉搏120次/分，脐周围及两肋腹部皮肤青紫。最有可能的诊断是
A. 急性重症胰腺炎
B. 急性胆囊炎
C. 急性胃炎
D. 急性肝炎
E. 肠梗阻

正确答案：A。急性重症胰腺炎

解析：中年男性患者，1天前饮大量酒（饮酒是急性胰腺炎的常见病因）后出现上腹痛、呕吐、吐后疼痛不减轻、加重伴腹胀3h（急性胰腺炎的典型症状）。血淀粉酶650U/dL（正常值40～180 U/dL，超过500U/dL有诊断价值），初步考虑诊断为急性胰腺炎。查体：脐周围及两肋腹部皮肤青紫（Grey-Turner征及Cullen征，急性重症胰腺炎的常见体征）。血压80/60mmHg（＜90/60mmHg，提示有休克），脉搏120次/分（正常为60～100次/分，考虑为胰腺出血坏死导致的休克的代偿表现）。综合患者的病史、查体、实验室检查，可诊断为急性重症胰腺炎（A对）。急性胆囊炎（九版外科学P444）（B错）主要表现为在饱餐或进食油腻食物后诱发的右上腹阵发性绞痛，常放射至右肩背部，右上腹腹膜刺激征，Murphy征阳性；急性胃炎（P354）（C错）常表现为上腹痛、腹胀、恶心、呕吐等，吐后疼痛可缓解；急性肝炎（八版传染病P26）（D错）主要表现为低热、全身疲乏无力、食欲减退，伴有恶心、呕吐等症状；肠梗阻（九版外科学P360）（E错）主要表现为腹痛、呕吐、腹胀、停止排气排便，均不会出现Grey-Turner征、Cullen征等。